女，35岁。发热、牙龈出血20天。查体：左侧颈部触及一个2cm×2cm大小淋巴结，质韧，无压痛。胸骨压痛（+），肝肋下未触及，脾肋下2cm。血常规：Hb105g/L，WBC3.6×10⁹/L，骨髓细胞学检查示大的原始细胞占0.80，细胞大小均一，胞浆内可见明显空泡，PAS细胞（+），其余细胞系受抑。该患者最可能的诊断是
A. 急性髓细胞白血病（M₁）
B. 急性淋巴细胞白血病（L₁）
C. 急性髓细胞白血病（M₂）
D. 急性淋巴细胞白血病（L₂）
E. 急性淋巴细胞白血病（L₃）

正确答案：E。急性淋巴细胞白血病（L₃）

解析：患者中年女性，发热、牙龈出血20天（贫血、发热、出血是急性白血病正常骨髓造血功能受抑的表现），查体：左侧颈部触及一个2cm×2cm大小淋巴结，质韧，无压痛。胸骨压痛（+）（白血病细胞浸润可使肝、脾淋巴结肿大，胸骨压痛，淋巴结肿大以ALL较常见，肝脾肿大多为轻至中度），肝肋下未触及，脾肋下2cm（脾轻度肿大）。血常规：Hb105g/L（正常值为110～150g/L），WBC3.6×10⁹/L（正常值为（4～10）×10⁹/L），骨髓细胞学检查示大的原始细胞占0.80（骨髓原始细胞≥骨髓有核细胞（ANC）的30%（FAB分型）或≥20%（WHO分型）即可诊断为急性白血病），细胞大小均一，胞浆内可见明显空泡（提示为L₃型），PAS细胞（+）（急性淋巴细胞白血病糖原染色（PAS）阳性），其余细胞系受抑。根据患者病史、体查及实验室检查，该患者最可能的诊断是急性淋巴细胞白血病（L₃）（E对）。急性淋巴细胞白血病（L₃）：原始和幼稚细胞以大细胞为主，大小较一致，细胞内有明显空泡，胞质嗜碱性，染色深。急性淋巴细胞白血病（L₁）（B错）：原始和幼淋巴细胞以小细胞（直径≤12μm）为主。急性淋巴细胞白血病（L₂）（D错）：原始和幼淋巴细胞以大细胞（直径﹥12μm）为主。急性髓细胞白血病（M₁）（A错）：原粒细胞占骨髓非红系有核细胞的90%以上，其中至少3%以上细胞为MPO阳性。急性细胞白血病（M₂）（C错）：原粒细胞占骨髓NEC的30～89%，其他粒细胞≥10%，单核细胞﹤20%。